有关开放性试验，描述不正确的选项是
A. 多适用于有主观观察指标的临床试验
B. 易于设计和实施
C. 研究的实施者知道分组的情况
D. 对研究对象可以及时作出处理
E. 容易产生偏倚

正确答案：A。多适用于有主观观察指标的临床试验

解析：本题考查开放性试验的相关内容。开放性试验即研究对象和研究实施者均知道实验组和对照组的分组情况，试验公开进行。这多适用于有客观观察指标或难以实施盲法的临床试验（A错，为本题正确答案），例如，关于外科手术、改变生活习惯（包括饮食、锻炼、吸烟等）的干预效果的观察。其优点是易设计和实施（B对），研究实施者了解分组情况（C对），便于对研究对象及时作出处理（D对），其主要缺点是容易产生偏倚（E对）。